医师抗菌药物处方权资格取消后，多久内不得恢复处方权
A. 3个月
B. 6个月
C. 12个月
D. 16个月
E. 18个月

正确答案：B。6个月

解析：医师处方权资格取消后，在6个月内不得恢复其处方权。掌握“抗菌药物临床应用、监督及法律责任”知识点。